区别三萜皂苷元和三萜皂苷用
A. 三氯乙酸反应
B. Molish反应
C. 中性乙酸铅试剂
D. IR光谱
E. 吉拉尔（Girard）试剂

正确答案：B。Molish反应

解析：本题考查的是苷类的显色反应。区别三萜皂苷元和三萜皂苷用Molish反应（B对）。苷类化合物由苷元和糖两部分组成，故苷类化合物能发生相应的苷元和糖的各种显色反应。苷元的结构多种多样。糖的显色反应中最重要的是Molish反应，常用的试剂由浓硫酸和α-萘酚组成。硫酸兼有水解苷键的作用，生成的单糖在浓硫酸的作用下，失去三分子水，生成具有呋喃环结构的醛类化合物。由五碳糖生成的是糠醛，甲基五碳糖生成的是5-甲糠醛，六碳糖生成的是5-羟甲糠醛。这些糠醛衍生物和许多芳胺、酚类可缩合成有色物质，可借此来检识糖和苷类化合物的存在。三氯乙酸反应（A错）：将含甾体皂苷样品的三氯甲烷溶液滴在滤纸上，加三氯乙酸试液1滴，加热至60℃，生成红色渐变为紫色。在同样条件下三萜皂苷必须加热至100℃才能显色，也生成红色渐变为紫色，可用于纸层析。中性乙酸铅试剂（C错）属于重金属，能与鞣质的水溶液反应。鞣质的水溶液能与乙酸铅、乙酸铜、氯化亚锡等重金属盐产生沉淀。这一性质通常用于鞣质的提取分离或除去中药提取液中的鞣质。IR光谱（D错）即红外光谱。某些情况下，IR光谱可用于区别芳环的取代方式、构型及构象等。吉拉尔（Girard）试剂（E错），2022年考试指南未明确说明。